cAMP对转录起始的调控是
A. 单独与操纵基因结合，封闭其基因表达
B. 以cAMP-CAP复合物与操纵基因结合，使该基因开放
C. 与RNApolⅡ结合，促进酶的活性
D. 与阻遇蛋白结合，去阻遏作用
E. 与增强子结合，促进转录

正确答案：B。以cAMP-CAP复合物与操纵基因结合，使该基因开放